肝阳上亢的治法是
A. 泻南补北
B. 扶土抑木
C. 滋水涵木
D. 培土生金
E. 佐金平木

正确答案：C。滋水涵木

解析：肝阴虚，不能制约肝阳，则导致肝阳上亢，所以治疗肝阳上亢应滋肝阴。因为在五行相生关系中，任何一行都具有“生我”和“我生”两方面的关系。肝属木，肾属水，水生木，所以可滋肾阴以养肝阴，以此来治疗肝阳上亢，故肝阳上亢的治法是滋水涵木（C对）。